面神经的分支有
A. 眼神经、上颌神经、下颌神经、颊神经、颈神经
B. 眼神经、耳颞神经、颊神经、下颌神经、颈神经
C. 眼支、上颌支、下颌支、下颌缘支、颈支
D. 颞支、颧支、颊支、下颌缘支、颈支
E. 颞支、颧支、颊支、颌下支、舌下支

正确答案：D。颞支、颧支、颊支、下颌缘支、颈支

解析：本题考查面神经。面神经在腮腺内的分支有颞支、颧支、颊支、下颌缘支及颈支（D对）。眼神经、上颌神经和下颌神经是三叉神经的三大分支，三叉神经与面神经同属脑神经（A错）。颊神经与耳颞神经是下颌神经的分支（B错）。眼支、上颌支、下颌支和舌下支不是面神经的分支（CE错）。